下列除哪项外均符合问诊的要求
A. 态度和蔼，言语亲切
B. 要将患者陈述的内容去粗取精，去伪存真
C. 交谈时避免使用特定意义的医学术语
D. 医生要多提出诱导性的问题
E. 对危重患者只扼要询问，待病情缓和后再补充

正确答案：D。医生要多提出诱导性的问题

解析：在问诊过程中，医生应避免诱导性提问，即避免在措辞上已暗示了期望的答案，使患者易于默认或符合医师的诱问，如：“你都胸痛放射至左手，对吗？”（D错，为本题正确答案）。医生在问诊过程中，应态度和蔼，言语亲切（A对）；要将患者陈述的内容去粗取精，去伪存真（B对）；交谈时避免使用特定意义的医学术语（C对），应注意不同文化背景的患者对各种医学词汇的理解有较大的差异；对危重患者只扼要询问，待病情缓和后再补充（E对）。